临床试验属于
A. 描述性研究
B. 分析性研究
C. 实验性研究
D. 理论与方法学研究
E. 统计分析法

正确答案：C。实验性研究

解析：本题考查实验流行病学的类型。实验流行病学（C对ABDE错）根据研究目的和研究对象的不同，通常可分为临床试验、现场试验和社区试验三类。